下列关于川芎的说法错误的是
A. 活血行气，祛风止痛
B. 辛温，归肝、胆、心包经
C. 可用于治疗头痛，风湿痹痛
D. 用于血瘀气滞的痛症
E. 消肿生肌

正确答案：E。消肿生肌

解析：川芎属活血化瘀药，具有活血行气、祛风止痛之效（A对），性味辛温，归肝、胆、心包经（B对），能够治疗头痛，风湿痹痛（C对），血瘀气滞等痛症（D对），为治疗气滞诸痛证之要药，有“血中气药”之称。川芎为治疗气滞血瘀诸症的常用药，但并没有消肿生肌之效（E错，为本题正确答案）。